中医学中，“证”的含义是
A. 对疾病所表现症状的综合认识
B. 对疾病症状与体征的分析过程
C. 对疾病某一阶段的病理概括
D. 对疾病症状与体征的调查过程
E. 阴阳失调的表现

正确答案：C。对疾病某一阶段的病理概括

解析：本题考查的是症、证、病的概念。中医学中，“证”的含义是对疾病某一阶段的病理概括（C对）。症，指疾病的外在表现，即症状（A错）。病，即疾病的简称，指有特定的致病因素、发病规律和病机演变的异常生命过程，具有特定的症状和体征（BD错）。所谓“证”，是机体在疾病发展过程中某一阶段的病机概括，包括病变的部位、原因、性质以及邪正关系，能够反映出疾病发展过程中某一阶段的病机变化的本质，因而它比症状能更全面、更深刻、更准确地揭示出疾病的发展过程和本质。阴阳失调（E错），即是阴阳消长失去平衡协调的简称。是指机体在疾病的发生发展过程中，由于各种致病因素的影响，导致机体阴阳消长失去相对的平衡，从而形成阴阳偏盛、偏衰，或阴不制阳、阳不制阴的病变状态。